男孩，6岁，发热伴皮疹2天，查体：咽部充血，双扁桃体Ⅱ度重大，可见脓性分泌物，杨梅舌，全身红色鸡皮样疹，皮肤潮红，双颌下各可触及一个1.0cm×0.5cm大小的淋巴结，有触痛，诊断是
A. 麻疹
B. 川崎病
C. 水痘
D. 猩红热
E. 幼儿急疹

正确答案：D。猩红热

解析：男童患者，发热伴皮疹2天，查体：咽部充血，双扁桃体Ⅱ度重大，可见脓性分泌物，杨梅舌（猩红热的特征性表现），全身红色鸡皮样疹，皮肤潮红，双颌下各可触及一个1.0cm×0.5cm大小的淋巴结，有触痛，综合患者的症状、体征和辅助检查，诊断是猩红热（D对）。麻疹（A错）可见Kopli斑，疹退后皮肤脱屑及色素沉着等。川崎病（B错）可见草莓舌。水痘（C错）一般无颈部淋巴结肿大及杨梅舌表现，PCR检测鼻咽分泌物病毒DNA可确诊。幼儿急疹（E错）常有轻度腹泻，皮疹为斑丘疹，无杨梅舌表现。